固定桥的固位作用主要来自
A. 黏固剂的黏着力
B. 材料的强度
C. 基牙的健康
D. 咬合平衡
E. 基牙制备和固位体制作的质量

正确答案：E。基牙制备和固位体制作的质量

解析：修复体的固位作用，主要依靠患牙预备后所形成的固位形，以及预备完成的修复体与患牙密切贴合产生的摩擦力。掌握“固定桥的设计”知识点。